某男，30岁。患咽喉肿烂、口舌生疮。医师在方中选用牛黄配珍珠，该配伍的功效是
A. 清热解毒、活血
B. 清热解毒、利尿
C. 清热解毒、散结
D. 清热解毒、化痰
E. 清热解毒、生肌

正确答案：E。清热解毒、生肌

解析：本题考查的是牛黄的配伍。某男，30岁。患咽喉肿烂、口舌生疮。医师在方中选用牛黄配珍珠，该配伍的功效是清热解毒、生肌（E对）。牛黄：【配伍】牛黄配珍珠：牛黄苦凉，功能清热解毒、息风止痉、化痰（D错）开窍；珍珠咸寒，功能镇心定惊、清肝除翳、收敛生肌。两药相配，治咽喉肿烂、口舌生疮，有清热解毒、生肌之效；治痰热神昏、中风痰迷，有清心凉肝、化痰开窍之功。